β肾上腺素受体阻断药可
A. 抑制胃肠道平滑肌收缩
B. 促进糖原分解
C. 加快心脏传导
D. 升高血压
E. 使支气管平滑肌收缩

正确答案：E。使支气管平滑肌收缩

解析：本题考查β受体阻断药。β受体阻断药可阻断平滑肌上的β受体，使支气管平滑肌收缩（E对）；使胃肠道平滑肌收缩（A错），抑制糖原分解（B错），延缓心脏传导（C错）；阻断心脏β₁受体，减慢心率及心收缩力，降低血压（D错）。